茜草的功效是
A. 凉血止血
B. 活血祛瘀
C. 二者均是
D. 二者均不是

正确答案：C。二者均是

解析：本题考查的是茜草的性能特点。茜草的功效是凉血止血与活血祛瘀（C对）。茜草：【性能特点】本品苦泄散，寒清凉，入肝经。炒炭行中有止，善化瘀、凉血而止血（A错）；生用则专于凉散，善活血凉血而化瘀（B错）通经。有止血而不留瘀、活血而不动血之长，凡出血无论属血瘀夹热还是血热夹瘀者皆宜，尤以血热血瘀兼出血者用之最佳。【功效】凉血，祛瘀，止血，通经。